注入颈内静脉的有
A. 甲状腺下静脉
B. 甲状腺上静脉
C. 颈外静脉
D. 椎静脉
E. 颈前静脉

正确答案：B。甲状腺上静脉

解析：面静脉、舌静脉、咽静脉、甲状腺中静脉和甲状腺上静脉（B对）注入颈内静脉。颈外静脉注入锁骨下静脉或静脉角。颈前静脉注入颈外静脉末端或锁骨下静脉。